关于维生素B₁₂理化性质说法错误的是
A. 含钴的类咕啉化合物
B. 弱酸条件下最稳定
C. 强酸（pH2）易分解
D. 遇红外线易被破坏
E. 遇热有一定程度破坏

正确答案：D。遇红外线易被破坏